患者，女，30岁。失眠多梦，易于惊醒，胆怯心悸，遇事善惊，气短乏力，舌淡，脉弦细其治选用
A. 酸枣仁汤
B. 琥珀多寐丸
C. 养心汤
D. 朱砂安神丸
E. 安神定志丸

正确答案：E。安神定志丸

解析：本题患者有失眠，心虚则心神不安，胆虚则善惊易恐，故多梦易醒，心悸善惊。心居胸中，心气亏虚，胸中宗气运转无力，则气短；心神失养则乏力；气短乏力为气虚之象。舌色淡，脉弦细，均为气血不足的表现。所以宜用具有益气镇惊，安神定志的安神定志丸（E对）；酸枣仁汤也可以用于治疗不寐的心胆气虚证，但偏于养血清热除烦（A错）；琥珀多寐丸治疗由肝火亢盛、肝热扰心、心神不宁引起的不寐（B错）；养心汤用于神思恍惚，心悸易惊，失眠健忘，舌淡脉细的气血不足，心神不宁证（C错）；朱砂安神丸用于心烦不寐，躁扰不宁，口干舌燥，小便短赤，口舌生疮，舌尖红，苔薄黄，脉数的心火炽盛证（D错）。